智力发展的关键期在
A. 3岁前
B. 4岁前
C. 5岁前
D. 6岁前
E. 7岁前

正确答案：E。7岁前